苯丙酮尿症新生儿筛查采用的是
A. 尿三氯化铁试验
B. 尿硝普钠试验
C. 血清苯丙氨酸浓度测定
D. Guthrie细菌抑制试验
E. 苯丙氨酸耐量试验

正确答案：D。Guthrie细菌抑制试验

解析：Guthrie细菌抑制试验（D对）测定苯丙氨酸的原理是因为苯丙氨酸能促进已被抑制的枯草杆菌重新生长，以生长圈的范围测定血中苯病氨酸的含量。是可以最早并且是最经济的苯丙酮尿症新生儿筛查手段。尿三氯化铁试验（A错）、2，4-二硝基苯肼试验（B错）一般用于较大儿童的初筛。血清苯丙氨酸浓度测定（C错）、苯丙氨酸耐量试验（E错）和四氢生物蝶呤负荷试验是用来确诊苯丙酮尿症的手段。